患者头痛且空，每兼眩晕，腰痛酸软，神疲乏力，遗精带下，耳鸣失眠，舌红少苔，脉细无力，此属何种头痛
A. 肝阳头痛
B. 肾虚头痛
C. 气血亏虚头痛
D. 瘀血头痛
E. 痰浊头痛

正确答案：B。肾虚头痛

解析：脑为髓海，其主在肾，现肾虚，髓不上荣，脑海空虚，故见头痛且空，每兼眩晕；腰为肾之府，肾虚则腰痛酸软；肾虚推动无功，则见神疲乏力；肾虚精关不固则遗精；女子则带脉不束而带下；肾开窍于耳，肾虚则耳鸣；失眠，则为肾阴不足，心肾不交之象；舌红少苔，脉细无力，均属于肾虚头痛的特点（B对）。肝阳头痛（A错）的特点为头痛而眩，两侧为甚，心烦易怒，睡眠不宁，胁痛，面红目赤，口苦。气血亏虚头痛（C错）的特点为头痛而晕，心悸不宁，面色少华，神疲乏力，舌淡，苔薄，脉细。瘀血头痛（D错）的特点为头痛经久不愈，痛处固定不移，痛如锥刺，或有头部外伤史。痰浊头痛（E错）的特点为头痛昏蒙，胸脘满闷，纳呆呕恶。